位于第9胸椎棘突下，旁开1.5寸的腧穴是
A. 脾俞
B. 胃俞
C. 胆俞
D. 肝俞
E. 肾俞

正确答案：D。肝俞

解析：肝俞定位在脊柱区，第9胸椎棘突下，后正中线旁开1.5寸（D对）。脾俞定位在脊柱区，第11胸椎棘突下，后正中线旁开1.5寸（A错）。胃俞定位在脊柱区，第12胸椎棘突下，后正中线旁开1.5寸（B错）。胆俞定位在脊柱区，第10胸椎棘突下，后正中线旁开1.5寸（C错）。肾俞定位在脊柱区，第2腰椎棘突下，后正中线旁开1.5寸（E错）。